某糖尿病、血脂异常患者已使用二甲双胍、甘精胰岛素以及瑞舒伐他汀等药物进行控血糖、调血脂治疗，需要监测的实验室指标有
A. 红细胞沉降率
B. 糖化血红蛋白
C. 血糖
D. 肌酸激酶
E. 低密度脂蛋白胆固醇

正确答案：B、C、D、E。糖化血红蛋白；血糖；肌酸激酶；低密度脂蛋白胆固醇

解析：本题考查糖尿病和高脂血症的监测指标。糖尿病患者需定期监测糖化血红蛋白（B对），以了解血糖的控制情况。也需自我监测血糖（C对），避免发生低血糖。对于糖尿病伴高脂血症，使用他汀类药物治疗期间，应控制血清LDL-C的目标水平，因此需要监测低密度脂蛋白（E对）。另外他汀类药物的不良反应有肌毒性、肝毒性，因此在用药期间需定期监测肌酸激酶（D对）、肝功能等。